属于心境稳定剂的药物是
A. 碳酸锂
B. 氢氧化铝
C. 硫酸镁
D. 苯妥英钠
E. 氟哌啶醇

正确答案：A。碳酸锂